《中国药典》中测定维生素E含量的方法是
A. 酸碱滴定法
B. 亚硝酸钠滴定法
C. 碘量法
D. 高效液相色谱法
E. 气相色谱法

正确答案：E。气相色谱法

解析：本题考查维生素E的含量测定。《中国药典》中测定维生素E含量的方法是气相色谱法（A对）。